烟酸的主要营养作用
A. 参与生物氧化过程
B. 是葡萄糖耐量因子的组成
C. 参与氨基酸与DNA的代谢
D. 以上都是
E. 以上都不是

正确答案：D。以上都是